初孕妇，26岁。妊娠38周，规律宫缩8小时，宫口开大6cm，S+1，胎膜已破，胎儿体重估计3000g，血压130/80mmHg，胎心144次/分。2小时后肛查：宫口6cm，边薄，先露S+1，宫缩力弱，20秒/5～6分，胎心好。应诊断为
A. 潜伏期延长
B. 活跃期延长
C. 活跃期停滞
D. 第二产程延长
E. 滞产

正确答案：B。活跃期延长

解析：总产程分为第一产程潜伏期→第一产程活跃期→第二产程→第三产程。第一产程潜伏期是指从临产规律宫缩开始至宫口开大3cm，活跃期是指宫口开大3～10cm，第二产程是指宫口开大10cm至胎儿娩出，第三产程是指胎儿娩出至胎盘娩出。本例宫口开大6cm属于第一产程活跃期，不属于第一产程潜伏期和第二产程（AD错）。活跃期停滞（C错）为活跃期宫口扩张停滞＞4小时，该孕妇进入活跃期后，宫口在2小时内未扩张。活跃期延长（B对）是指初产妇活跃期超过8小时。总产程超过24小时，称为滞产（E错）。